叶片淡绿色或灰绿色，先端钝，有小芒尖，边缘具细齿，常反卷，两面无毛的药材是
A. 侧柏叶
B. 蓼大青叶
C. 紫苏叶
D. 枇杷叶
E. 罗布麻叶

正确答案：E。罗布麻叶

解析：本题考查的是罗布麻叶药材的性状鉴别。叶片淡绿色或灰绿色，先端钝，有小芒尖，边缘具细齿，常反卷，两面无毛的药材是罗布麻叶（E对）。罗布麻叶：【性状鉴别】药材多皱缩卷曲，有的破碎，完整叶片展平后呈椭圆状披针形或卵圆状披针形，淡绿色或灰绿色，先端钝，有小芒尖，基部钝圆或楔形，边缘具细齿，常反卷，两面无毛，叶脉于下表面突起；叶柄细。质脆，气微，味淡。侧柏叶（A错）：【性状鉴别】药材多分枝，小枝扁平。叶细小鳞片状，交互对生，贴伏于枝上，深绿色或黄绿色。质脆，易折断。气清香，味苦涩、微辛。蓼大青叶（B错）：【性状鉴别】药材叶多皱缩、破碎。完整者展平后呈椭圆形，蓝绿或蓝黑色，先端钝，基部渐狭，全缘。叶脉浅黄棕色，于下表面略突起。叶柄扁平，偶带膜质托叶鞘。质脆。气微，味微涩而稍苦。紫苏叶（C错）：【性状鉴别】药材叶片多皱缩卷曲、破碎，完整的叶展平后呈卵圆形，先端长尖或急尖，基部圆形或宽楔形，边缘具圆锯齿。两面紫色或上表面绿色，下表面紫色，疏生灰白色毛，下表面有多数凹点状的腺鳞。叶柄紫色或紫绿色。质脆。带嫩枝者，枝紫绿色，断面中部有髓。气清香，味微辛。枇杷叶（D错）：【性状鉴别】药材呈长椭圆形或倒卵形。先端尖，基部楔形，边缘上部有疏锯齿，近基部全缘。上表面灰绿色、黄棕色或红棕色，较光滑；下表面密被黄色绒毛，主脉于下表面显著突起，侧脉羽状；叶柄极短，被棕黄色绒毛。革质而脆、易折断。气微、味微苦。